阑尾穴的定位是
A. 在膝上部，髌底的中点上方2寸处
B. 在小腿外侧，腓骨小头直下2寸
C. 屈膝，在髌韧带两侧凹陷处
D. 在小腿内侧，内踝尖上5寸，胫骨内侧面的中央
E. 在小腿前侧上部，当犊鼻下5寸，胫骨前缘旁开一横指

正确答案：E。在小腿前侧上部，当犊鼻下5寸，胫骨前缘旁开一横指

解析：阑尾定位在小腿外侧，髌韧带外侧凹陷下5寸（犊鼻下5寸），胫骨前嵴外一横指（E对）。